老年男性急性尿潴留常见病因是
A. 前列腺增生
B. 尿道结石
C. 尿道外伤
D. 膀胱异物
E. 尿道肿瘤

正确答案：A。前列腺增生

解析：前列腺增生、尿道结石、尿道外伤、膀胱异物和尿道肿瘤等均可引起尿潴留，其中前列腺增生（A对）是老年男性急性尿潴留最常见的病因。